思维形式障碍不包括
A. 思维散漫
B. 赘述症
C. 持续语言
D. 思维中断
E. 思维化声

正确答案：C。持续语言

解析：思维形式障碍包括1.思维奔逸 2.思维迟缓 3.思维贫乏 4.思维散漫（A对） 5.病理性赘述（B对） 6.思维中断（D对） 7.思维被夺 8.强制性思维 9. 思维不连贯10.思维化声（E对）11.语词新作 12.象征性思维 13.逻辑倒错性思维 14.强迫思维。思维活动形式障碍：持续言语（C错，为本题正确答案）、刻板言语、重复言语、模仿言语。